环境卫生工作中常见的二次污染物有
A. 二氧化硫和颗粒物
B. 铅、镉、汞、酚
C. 光化学烟雾
D. 氮氧化物、碳氢化物
E. 环境内分泌干扰物

正确答案：C。光化学烟雾

解析：本题考查二次污染物。二次污染物是指某些一次污染物进入环境后在物理、化学或生物学作用下，或与其他物质发生反应而形成与初始污染物的理化性质和毒性完全不同的新的污染物。环境卫生工作中常见的二次污染物有光化学烟雾（C对ABDE错），包括臭氧、醛类以及各种过氧酰基硝酸酯（PANs），且一般来说，二次污染物对环境和人体的危害要比一次污染物大。